丹皮酚软膏的组成有丹皮酚50g、丁香油7ml、硬脂酸110g、单硬脂酸甘油酯25g、碳酸钾9g、三乙醇胺3ml、甘油100g、蒸馏水720ml。该制剂的基质属于
A. 油脂类基质
B. O/W型基质
C. 类脂类基质
D. W/O型基质
E. 水溶性基质

正确答案：B。O/W型基质

解析：本题考查丹皮酚软膏的注解。丹皮酚软膏【注解】硬脂酸与碳酸钾生成硬脂酸钾，三乙醇胺与部分硬脂酸形成有机铵皂（三乙醇胺皂），为O/W型乳化剂（B对）。单硬脂酸甘油酯增加油相的吸水能力，并作为稳定剂。甘油为保湿剂。油脂性基质（A错）特点油脂性基质包括油脂类、类脂类、烃类等。主要特点是润滑、无刺激性，能封闭皮肤表面，促进皮肤的水合作用，对皮肤的保护及软化比其他基质强。能与多种药物配伍，但油腻性及疏水性较大，药物释放较差，不易与水性液体混合，也不易用水洗除，不宜用于急性炎性渗出较多的创面。类脂类基质（C错）系高级脂肪酸与高级脂肪醇形成的酯类，其物理性质与油脂类相似。②油包水（W/O）型乳剂基质（D错）：能吸收部分水分，但不能与多量水混合，透皮良好，涂展性佳。油包水型乳化剂有钙皂、羊毛脂、单甘酯、脂肪醇等。水溶性基质（E错）的特点水溶性基质是由天然或合成的高分子水溶性物质组成。该类基质释药较快，无油腻性和刺激性，能吸收组织渗出液，可用于糜烂创面及腔道黏膜，但润滑作用较差，易失水、发霉，故需加保湿剂与防腐剂。